妊娠合并糖尿病对胎儿的影响不正确的是
A. 巨大胎儿
B. 胎儿生长受限
C. 流产
D. 羊水过少
E. 胎儿畸形

正确答案：D。羊水过少